患者，男，60岁，诊断为房性心律失常，医生给予胺碘酮治疗。近日，因胃溃疡开始用西咪替丁，出现窦性心动过缓症状。合用西咪替丁，出现窦性心动过缓，原因是
A. 西咪替丁抑制CYP1A2，升高胺碘酮血浆药物浓度
B. 西咪替丁诱导CYP2C9，升高胺碘酮血浆药物浓度
C. 胺碘酮与西咪替丁竞争CYP2C19，减慢胺碘酮的代谢
D. 西咪替丁抑制CYP3A4，升高胺碘酮血浆药物浓度
E. 胺碘酮与西咪替丁竞争CYP2D6 ，减慢胺碘酮的代谢

正确答案：D。西咪替丁抑制CYP3A4，升高胺碘酮血浆药物浓度

解析：本题考查药物的相互作用。胺碘酮是肝药酶CYP3A4（CE错）的代谢底物，西咪替丁抑制CYP3A4，增加胺碘酮血浆药物浓度（D对），所以合用西咪替丁后患者出现窦性心动过缓。西咪替丁分子中含有咪唑环结构，咪唑环与肝药酶有较强的亲和力，西咪替丁为CYP3A4、CYP2C9、CYP1A2等肝药酶的抑制剂，可通过抑制CYP3A4，升高胺碘酮血浆药物浓度（AB错）。利福平是肝药酶诱导剂，可通过诱导CYP3A4，降低胺碘酮血浆药物浓度。